患者，女，65岁，因高血压长期服用硝苯地平控释片，血压控制良好，为防止导致低血压，今后用药中，应避免使用的药物有
A. 胺碘酮
B. 克拉霉素
C. 西咪替丁
D. 卡马西平
E. 伊曲康唑

正确答案：A、B、C、E。胺碘酮；克拉霉素；西咪替丁；伊曲康唑

解析：本题考查肝药酶抑制剂。肝药酶抑制剂能抑制药物的代谢，延长药物在体内的时间。胺碘酮（A对）、西咪替丁（C对）、伊曲康唑（E对）、克拉霉素（B对）为肝药酶抑制剂，应避免使用。卡马西平（D错）属于肝药酶诱导剂。